在用药期间应检查眼底
A. 卡马西平
B. 乙胺丁醇
C. 褪黑素
D. 环孢素
E. 氟桂利嗪

正确答案：B。乙胺丁醇

解析：本题考查乙胺丁醇的使用。在用药期间应检查眼底的是乙胺丁醇（B对）。乙胺丁醇可引起球后视神经炎，治疗期间应监测眼部，视野、视力、红绿鉴别力等，在用药前、疗程中每日检查一次，尤其是疗程长、每日剂量超过15mg/kg患者。